肠系膜上动脉的分支不包括
A. 右结肠动脉
B. 空肠动脉
C. 直肠上动脉
D. 中结肠动脉
E. 回结肠动脉

正确答案：C。直肠上动脉

解析：右结肠动脉（A对）、空肠动脉（B对）、中结肠动脉（D对）、回结肠动脉（E对）均为肠系膜上动脉的分支。直肠上动脉（C错，为本题正确答案）为肠系膜下动脉的分支。